关于学校健康促进的表述，下述哪项不正确
A. 学校、家长和学校所属社区内所有成员的共同参与
B. 设置正式和非正式的健康教育课程
C. 创造安全健康的学习环境，提供合适的健康服务
D. 共同促进学生健康
E. 移风易俗

正确答案：E。移风易俗